酸不溶性灰分使用的酸
A. 稀盐酸
B. 稀磷酸
C. 稀硫酸
D. 稀醋酸
E. 稀磷酸

正确答案：A。稀盐酸

解析：本题考查的是酸不溶性灰分测定法。酸不溶性灰分使用的酸稀盐酸（A对）。《中国药典》规定的灰分测定法有两种：总灰分测定法和酸不溶性灰分测定法。酸不溶性灰分是指总灰分中不溶于稀盐酸的灰分。